有关阴茎的描述，错误的是
A. 由两个阴茎海绵体和一个尿道海绵体构成
B. 可分为根、体和头三部分
C. 体为活动部，根为固定部
D. 尿道海绵体后端膨大形成尿道球，内含尿道球腺
E. 皮肤薄而柔软，富有色素

正确答案：D。尿道海绵体后端膨大形成尿道球，内含尿道球腺

解析：阴茎由两个阴茎海绵体和一个尿道海绵体构成（A对）。分为头、体和根三部分（B对）。阴茎体为活动部，阴茎根为固定部（C对）。尿道海绵体后端膨大形成尿道球，尿道球腺（D错，为本题正确答案）位于会阴深横肌内。皮肤薄而柔软，颜色较深（E对）。